湿温初起面色多见
A. 萎黄
B. 淡黄
C. 桔黄
D. 深黄
E. 苍黄

正确答案：B。淡黄

解析：湿温初起内外合邪，卫气同病，湿重热轻（湿邪偏盛），故面色多见淡黄（B对）。